藏象学说主要是研究
A. 脏腑的生理
B. 脏腑的病理
C. 脏腑之间的关系
D. 脏腑的解剖形态
E. 脏腑的生理病理及其相互关系

正确答案：E。脏腑的生理病理及其相互关系

解析：该题主要考查中医学的藏象学说的内容。藏象学说，是研究人体脏腑生理功能、病理变化规律及相互关系的学说。（E对）